某食品厂在生产腌鱼过程中，添加了少量的亚硫酸钠以起到漂白和防腐的作用。对此种做法的卫生评价是
A. 正确
B. 不正确，亚硫酸钠会使腌鱼褪色
C. 不正确，亚硫酸钠会破坏维生素及矿物质
D. 不正确，亚硫酸钠的残留气味会掩盖腌鱼的腐败味
E. 不正确，亚硫酸钠不起漂白作用

正确答案：D。不正确，亚硫酸钠的残留气味会掩盖腌鱼的腐败味